治愈率
A. 治疗好转的例数／治疗的总例数✕100%
B. 治愈人数／治疗的总例数✕100%
C. 随访5年尚存活的病例数／随访5年的总病例数✕100%
D. 对照组发病率／实验组发病率
E. （对照组发病率﹣实验组发病率）／对照组发病率✕100%

正确答案：B。治愈人数／治疗的总例数✕100%